对于舌侧倾斜的下磨牙，全冠的舌侧龈边缘最好为
A. 带斜面的肩台
B. 135°肩台
C. 90°肩台
D. 凹槽形
E. 刃状

正确答案：E。刃状

解析：①90°肩台：用于PFM冠，切割牙体组织较多，密合度较差。②135°肩台：易于保护牙髓，提高密合程度，现多用于PFM冠。③带斜坡肩台：主要用于PFM冠。④凹形：常用于金属全冠。有特定的外形线保存牙体组织及的完整性。⑤带斜坡的凹形：多用于全瓷冠。⑥刃状：多用于金属全冠或金沉积烤瓷冠。切割牙体组织最少。掌握“修复体试戴、磨光与粘固”知识点。